治疗男性阴茎勃起功能障碍宜选用的药物是
A. 氯米芬
B. 苯丙酸诺龙
C. 他莫昔芬
D. 乙葳酚
E. 西地那非

正确答案：E。西地那非

解析：本题考查西地那非。西地那非（E对）选择性抑制磷酸二酯酶V的活性，用于治疗阴茎勃起功能障碍。氯米芬（A错）具有较强的抗雌激素作用和较弱的雌激素活性。苯丙酸诺龙（B错）具有蛋白同化作用。他莫昔芬（C错）用于治疗晚期乳腺癌和卵巢癌。乙葳酚（D错）用于预防与治疗睾丸炎。